热能过剩主要与以下哪些慢性退行性疾病有关
A. 糖尿病
B. 肥胖
C. 高血脂
D. 以上都是
E. 以上都不是

正确答案：D。以上都是